蛇胆川贝胶囊善治
A. 风热咳嗽
B. 风寒咳嗽
C. 肺热咳嗽
D. 燥咳无痰
E. 痰湿阻肺

正确答案：C。肺热咳嗽

解析：本题考查的是蛇胆川贝散的主治。蛇胆川贝胶囊善治肺热咳嗽（C对）。蛇胆川贝散：【主治】肺热咳嗽，痰多。川贝止咳露：【主治】风热咳嗽（A错），痰多上气或燥咳。杏苏止咳颗粒：【主治】风寒感冒咳嗽（B错）、气逆。养阴清肺膏：【主治】阴虚燥咳，咽喉干痛，干咳少痰（D错），或痰中带血。清气化痰丸：【主治】痰热阻肺（E错）所致的咳嗽痰多、痰黄黏稠、胸腹满闷。